关于自发性气胸，以下哪项是错误的
A. 自发性气胸是指非人工因素导致脏层胸膜和肺泡破裂，肺内气体通过裂口进入胸膜腔而产生的气胸
B. 自发性气胸是指创伤因素导致脏层胸膜和肺泡破裂，肺内气体通过裂口进人胸膜腔而产生的气胸
C. 外伤造成壁层胸膜破裂，外面空气通过裂口进人胸膜腔而产生的气胸
D. 按病因自发性气胸可分为：原发性气胸和继发性气胸
E. 按胸膜裂口自发性气胸可分为：闭合性气胸、开放性气胸和张力性气胸

正确答案：C。外伤造成壁层胸膜破裂，外面空气通过裂口进人胸膜腔而产生的气胸

解析：自发性气胸是指非人工因素或创伤因素导致脏层胸膜和肺泡破裂，肺内气体通过裂口进入胸膜腔而产生的气胸。外伤造成壁层胸膜破裂而导致的气胸不属于自发性气胸范畴。掌握“气胸”知识点。